胎儿脑发育的关键期是
A. 孕24周至出生后1年
B. 孕30周至出生后2年
C. 孕30周至出生后1年
D. 孕32周至出生后1年
E. 孕28周至出生后2年

正确答案：C。孕30周至出生后1年